以下是环境卫生学在灾区处置尸体的卫生要求或措施，除外
A. 有火葬条件时，尸体尽量火葬
B. 土葬时，在土壤生物有效层内尸体尽量深埋
C. 要求土壤环境条件能使尸体尽快腐败分解，达到无机化和无害化
D. 当尸体出现尸臭时，可以使用感官、物理和化学方法除臭
E. 根据死者家属要求确定尸体进行土葬或火葬

正确答案：E。根据死者家属要求确定尸体进行土葬或火葬

解析：本题考查灾区处置尸体的卫生要求或措施。大型自然灾害发生时，造成的死亡人数往往较多，对尸体的处理应尽量采用火葬方法（A对）。在无火葬的条件下，可进行土葬处理（E错，为本题正确答案）。土葬时，在土壤生物有效层内尸体尽量深埋（B对），要求土壤环境条件能使尸体尽快腐败分解，达到无机化和无害化（C对）。当尸体出现尸臭时，可以使用感官、物理和化学方法除臭（D对）。